男，重体力劳动工人。腰腿痛，向左下肢放射，咳嗽、喷嚏时加重1月。检查：腰部活动明显受限，并向左倾斜，直腿抬高试验阳性。病程中无低热盗汗消痩症状。如果病史2年，并逐年加重，己严重影响生活及工作，且出现大小便障碍。其治疗方法应采取
A. 手术
B. 按摩
C. 牵引
D. 用药
E. 物理疗法

正确答案：A。手术

解析：患者男性、重体力劳动工人，腰腿痛、向左下肢放射、咳嗽喷嚏时加重（腰椎间盘突出症典型表现），腰部活动明显受限、向左倾斜，直腿抬高试验阳性（腰椎间盘突出症的重要体征），结合患者症状和体征，该患者首先考虑的诊断是腰椎间盘突出症。患者出现大小便障碍，提示有马尾神经受累，且患者病史已达2年、并逐渐加重，已严重影响生活及工作，故其治疗方法应采取手术（A对）。按摩（B错）、牵引（C错）、用药（D错）及物理疗法（E错）等非手术治疗方案仅可缓解症状，主要用于初次发病，病程较短和症状可自行缓解的病人。